番泻叶的伪品耳叶番泻叶不同于正品的性状特征有
A. 呈卵形或倒卵圆形
B. 先端钝圆或微凹下
C. 小叶基部不对称
D. 红棕色
E. 表面密被灰白色长茸毛

正确答案：A、B、C、D。呈卵形或倒卵圆形；先端钝圆或微凹下；小叶基部不对称；红棕色